牙髓增龄性变化，表现在牙髓细胞中，其叙述错误的是
A. 牙髓组织中的细胞成分减少
B. 成牙本质细胞由扁平状变为高柱状
C. 成牙本质细胞凋亡
D. 成纤维细胞减少，纤维数量增多
E. 血管出现局部炎症反应

正确答案：B。成牙本质细胞由扁平状变为高柱状

解析：随着年龄的增长和牙齿受到外界的生理或者病理性刺激，继发性牙本质和（或）修复性牙本质等不断形成，可使髓腔逐渐减小。牙髓组织中的细胞成分逐渐减少。成牙本质细胞由高柱状变为矮柱状或扁平，部分成牙本质细胞凋亡，剩余的成牙本质细胞对刺激的反应缓慢。成纤维细胞数量减少，同时伴纤维的数量和大小的增加。血管中可出现机体其它部位出现的胆固醇沉积，造成血管壁黏性增加并引起局部炎症反应。牙髓活力降低，出现退行性改变。掌握“牙髓”知识点。